非甾体抗炎药双氯芬酸结构中含有二苯胺片段，当长时间或大剂量用该药物时可能会引起肝脏毒性，其原因是
A. 药物与非治疗靶标结合产生的副作用
B. 药物的代谢产物产生的副作用
C. 药物抑制了心脏快速延迟整流钾离子通道（hERG）产生的副作用
D. 药物抑制细胞色素P450酶产生的副作用
E. 药物与非治疗部位靶标结合产生的副作用

正确答案：B。药物的代谢产物产生的副作用

解析：本题考查药物毒副作用。非甾体抗炎药双氯芬酸结构中含有二苯胺片段，当长时间或大剂量用该药物时可能会引起肝脏毒性，其原因是药物的代谢产物产生的副作用（B对）。非甾体抗炎药双氯芬酸的结构中含有二苯胺片段，在A环胺基的对位由于没有取代基，故可被CYP3A4或MPO催化代谢氧化，得到4-羟基双氯芬酸，并进一步发生双电子氧化生成强亲电性亚胺-醌，后者可与体内蛋白或谷胱甘肽发生亲核取代，生成与蛋白的加成产物，从而引发肝脏毒性。药物与非治疗靶标结合（A错）是指药物在体内一药多靶的现象。如大环内酯类抗生素红霉素类药物。药物抑制了心脏快速延迟整流钾离子通道（hERG）产生的副作用（C错）：hERG定位于人7号染色体，编码1159个氨基酸残基，分子量约为127kD。如抗过敏药物特非那定、阿司咪唑因干扰心肌细胞K⁺通道，引发致死性尖端扭转型室性心动过速，导致药源性心律失常。药物抑制细胞色素P450酶产生的副作用（D错）：药物对CYP450的抑制作用会导致体内CYP450的活性降低，对其它同时使用的药物的代谢降低和减少，增加药物的毒副作用。药物与非治疗部位靶标结合产生的副作用（E错）：如选择性COX-2抑制剂的非甾体抗炎药物罗非昔布、伐地昔布等所产生心血管不良反应。